炮制黄芩应选用
A. 蒸法
B. 煮法
C. 水飞法
D. 蝉法
E. 煅法

正确答案：A。蒸法